特定基因编码、调控另一基因转录激活的转录因子是
A. 顺式作用元件
B. 反式作用元件
C. 顺式作用因子
D. 反式作用因子
E. 顺/反式作用元件

正确答案：D。反式作用因子